患者，男，56岁，患类风湿性关节炎，长期口服糖皮质激素。因出现寒战、高热、伴咳嗽、咳痰就诊。痰培养提示铜绿假单胞菌感染。宜选用的药物是
A. 头孢唑林
B. 头孢呋辛
C. 头孢曲松
D. 头孢噻肟
E. 头孢他啶

正确答案：E。头孢他啶

解析：本题考查铜绿假单胞菌抗感染治疗。铜绿假单胞菌感染首选抗假单胞菌的β-内酰胺类抗菌药物如：头孢他啶2g iv q8h、头孢吡肟2g iv q8h、头孢哌酮-舒巴坦2～4g iv q8～12h、哌拉西林-他唑巴坦4.5g iv q8h、亚胺培南500mg iv q8h、美罗培南1g iv q8h；或联合环丙沙星400mg iv q8～12h、左氧氟沙星500～750mg iv qd、阿米卡星15～20mg/kg iv qd等进行治疗。